能够引起晕厥的心脏瓣膜病是
A. 二尖瓣关闭不全
B. 主动脉瓣关闭不全
C. 三尖瓣关闭不全
D. 肺动脉瓣狭窄
E. 主动脉瓣狭窄

正确答案：E。主动脉瓣狭窄

解析：主动脉瓣狭窄患者主要表现为呼吸困难、心绞痛、晕厥（E对），晕厥多与劳累有关，发生于劳力当时，少数在休息时发生。二尖瓣关闭不全患者主要表现为劳力性呼吸困难、左心衰竭症状甚至肺水肿、心源性休克等（A错）。主动脉瓣关闭不全患者主要表现为心悸、心前区不适、头颈部强烈动脉搏动感、心绞痛、改变体位时可出现头晕或眩晕，晕厥罕见（B错）。三尖瓣关闭不全患者主要表现为乏力、头颈静脉搏动感、胃肠道淤血所致腹胀、胃食欲不振、消化不良等（C错）。肺动脉瓣狭窄呼吸困难、心悸、乏力、胸闷、咳嗽、偶有胸痛等（D错）。